患残髓炎的患牙，若使用强温度刺激，则可产生
A. 牙本质敏感
B. 一过性疼痛
C. 迟缓性反应痛
D. 无反应
E. 剧烈疼痛

正确答案：C。迟缓性反应痛

解析：强温度刺激残髓炎患牙可引起患牙迟缓性痛，叩痛（+）或（±）。掌握“残髓炎及逆行性牙髓炎”知识点。